肾小管性酸中毒时出现
A. 酸中毒时酸性尿
B. 反常性碱性尿
C. 碱中毒时碱性尿
D. 反常性酸性尿
E. 酸碱平衡时酸性尿

正确答案：B。反常性碱性尿

解析：肾小管性酸中毒分为I型和II型，前者导致肾小管功能障碍导致尿液不能被酸化，后者导致Na+-H+转运体功能障碍，碳酸酐酶活性降低，HC03-在近曲小管重吸收减少，尿中HC03-排出增多，两者都可以导致尿液PH值上升出现反常性碱性尿（B对）。